可采用随机、双盲、对照试验，对受试药的有效性和安全性做出初步药效学评价，推荐给药剂量的新药研究阶段是
A. Ⅰ期临床试验
B. Ⅱ期临床试验
C. Ⅲ期临床试验
D. Ⅳ期临床试验
E. 0期临床试验

正确答案：B。Ⅱ期临床试验

解析：本题考查临床药理学研究。可采用随机、双盲、对照试验，对受试药的有效性和安全性做出初步药效学评价，推荐给药剂量的新药研究阶段是Ⅱ期临床试验（B对）。Ⅱ期临床试验：为初步药效学评价试验，对受试药的有效性和安全性做出初步评价，采用随机盲法对照试验，大于100人。Ⅰ期临床试验（A错）：为人体安全性评价试验，观察人体对于受试药的耐受程度和人体药动学特征，20~30人；Ⅲ期临床试验（C错）：进一步评价受试药的有效性、安全性、利益与风险，大于300例；Ⅳ期临床试验（D错）：为批准上市后的监测，是受试新药上市后在社会人群大范围内继续进行的安全性和有效性评价。0期临床试验（E错）是指活性化合物在完成临床前试验后未正式进入临床试验之前，研制者使用微剂量在少量健康志愿者或者病人（通常为6～15人）进行的药物试验，收集必要的有关药物安全及药代动力学的试验数据，以评估研发药物是否具有进一步开发为新药或生物制剂的可能性，是从临床前试验过渡到Ⅰ期临床试验的中间环节。